抽样误差是由
A. 测量仪器的原因所致
B. 不正确的操作方法造成
C. 抽样研究中无法避免的
D. 选择调查对象方法不正确
E. 被调查对象回答问题不准确造成

正确答案：C。抽样研究中无法避免的

解析：本题考查抽样误差的特点。抽样误差是随机抽样过程中产生的样本与总体之间的差异。样本量是影响抽样误差的重要因素，抽样误差在抽样研究中是无法避免的（C对ABDE错）。